下列哪项属于非自伤性溃疡
A. 褥疮性溃疡
B. 自伤性溃疡
C. 化学灼伤性溃疡
D. 热损伤性溃疡
E. 以上均是

正确答案：A。褥疮性溃疡

解析：本题考查创伤性溃疡。非自伤性溃疡指口腔中各种导致创伤性溃疡的机械性刺激因素引起相应部位的溃疡。褥疮性溃疡（A对）由持久的非自伤性机械刺激造成，多见于老年人，残根残冠或不良修复体长期损伤黏膜，溃疡深及黏膜下层，边缘轻度隆起，色泽灰白，疼痛不明显，属于非自伤性溃疡。自伤性溃疡（B错）好发于性情好动的青少年或患多动症的儿童。由自伤性刺激引起，患者常有下意识地咬唇、咬颊或用铅笔尖、竹筷等尖锐物点刺颊脂垫等不良习惯。化学灼伤性溃疡（C错）由刺激性的化学药物或修复材料引起的口腔黏膜损伤。热损伤性溃疡（D错）因饮料、开水、食物过烫引起的黏膜灼伤；或因口腔内低温治疗操作不当引起的冻伤。